卡特尔认为人格是由什么构成的
A. 人格因素
B. 人格特征
C. 根源特质
D. 表面特质
E. 人格特质

正确答案：E。人格特质